主要通过选择性抑制5-HT再摄取而起到抗抑郁作用的药物是
A. 马普替林
B. 度洛西汀
C. 帕罗西汀
D. 吗氯贝胺
E. 米氮平

正确答案：C。帕罗西汀

解析：本题考查抗抑郁药。主要通过选择性抑制5-HT再摄取而起到抗抑郁作用的药物是帕罗西汀（C对）。选择性5-羟色胺再摄取抑制剂（SSRI）主要通过选择性抑制5-HT的再摄取，增加突触间隙5-HT浓度，从而增强中枢5-HT能神经功能，发挥抗抑郁作用。代表药物有氟西汀、帕罗西汀、舍曲林、西酞普兰等。马普替林（A错）是四环类抗抑郁药。度洛西汀（B错）是5-HT及去甲肾上腺素再摄取抑制剂（SNRI）。吗氯贝胺（D错）是单胺氧化酶抑制剂。米氮平（E错）是去甲肾上腺素能及特异性5-HT能抗抑郁药。